下列有关乳磨牙髓室的叙述中，不恰当的是
A. 乳磨牙髓室通常均有3个根管
B. 上颌乳磨牙有2个颊侧根管，1个舌侧根管
C. 下颌乳磨牙有两个近中根管，1个远中根管
D. 下颌第二乳磨牙不会出现4个根管
E. 乳磨牙髓室较大

正确答案：D。下颌第二乳磨牙不会出现4个根管

解析：本题考查乳磨牙髓室的形态特点。下颌第二乳磨牙不会出现4个根管（D错，为本题正确答案）不符合乳磨牙髓室的形态特点。下颌第二乳磨牙有时可出现4个根管，其分布为近中两个根管，远中两个根管。乳磨牙髓室较大（E对），通常均有3个根管（A对）：上颌乳磨牙有2个颊侧根管，1个舌侧根管（B对）；下颌乳磨牙有两个近中根管，1个远中根管（C对）。